酮体不能在肝中氧化是因为肝中缺乏下列哪种酶
A. HMG-CoA合成酶
B. HMG-CoA还原酶
C. HMG-CoA裂解酶
D. 琥珀酰CoA转硫酶
E. 琥珀酸脱氢酶

正确答案：D。琥珀酰CoA转硫酶